在真核生物中，经RNA聚合酶Ⅱ催化产生的转录产物是
A. mRNA
B. 18SrRNA
C. 28SrRNA
D. tRNA
E. 全部RNA

正确答案：A。mRNA

解析：RNA聚合酶Ⅱ位于核内，催化转录生成hnRNA，然后加工成mRNA并输送给胞质的蛋白质合成体系。掌握“RNA的生物合成”知识点。